蛋白质生物学价值最高的是
A. 肉类
B. 谷类
C. 蛋类
D. 牡蛎
E. 豆类

正确答案：C。蛋类